以下有关口呼吸的相关叙述中，正确的是
A. 口呼吸时，下颌下降致使舌体下降
B. 可能导致患者上颌基骨较窄
C. 可造成双唇分开
D. 可出现牙弓前后发育过度，牙弓形态窄长
E. 以上均正确

正确答案：E。以上均正确

解析：口呼吸时，下颌下降致使舌体下降，上颌内侧缺乏横向肌张力作用，而外侧颊肌作用相对较强，颌骨内外肌力不平衡可能导致患者上颌基骨较窄。下颌下降同时造成双唇分开，上唇部肌力减弱，下唇与上切牙脱离接触。因此患者的牙弓前后发育过度，牙弓形态窄长，牙弓突度较大，上切牙唇倾等异常可能与上唇部肌力减弱有关。掌握“吞咽、呼吸及言语”知识点。